适用于“主动-被动型”医患关系模式的患者群体中一般不包括
A. 昏迷患者
B. 婴幼儿患者
C. 焦虑症患者
D. 痴呆患者
E. 精神分裂症缺乏自知力患者

正确答案：C。焦虑症患者

解析：医患关系分为三种类型：主动-被动型、指导-合作型、共同参与型。主动-被动型指医师主动命令，病人被动服从，适合难以表述自己主观意见的病人，如麻醉、严重昏迷的患者（A对）、婴幼儿患者（B对）、痴呆患者（D对）、精神分裂症缺乏自知力患者（E对）等。共同参与型指医患双方共同制定并实施诊断方案，适合慢性疾病病人和心理疾病病人，如焦虑症患者（C错，为本题正确答案）。指导-合作型指在医疗活动中，医患双方具有一定的主动性，但仍以医务人员为主，适合于急性感染期患者。